空气样品采集时，定点区域采样的最短采样时间应不少于
A. 3分钟
B. 5分钟
C. 8分钟
D. 10分钟
E. 15分钟

正确答案：B。5分钟